关于多牙列的说法错误的是
A. 槽生牙属于多牙列
B. 端生牙或侧生牙属于多牙列
C. 多牙列牙齿缺失以后可由后备牙补充
D. 多牙列能够去旧更新，终生不止
E. 大部分硬骨鱼，爬行类为多牙列

正确答案：A。槽生牙属于多牙列

解析：多牙列：在端生牙或侧生牙的舌侧有若干后备牙，牙缺失后可由后备牙补充，去旧更新，终生不止，故名为多牙列。大部分硬骨鱼类、两栖类、和爬行类为多牙列。掌握“牙的演化”知识点。